测量病毒大小的常用单位是
A. 厘米（cm）
B. 毫米（mm）
C. 微米（μm）
D. 纳米（nm）
E. 皮米（pm）

正确答案：D。纳米（nm）